某妇女的末次月经是在2003年11月30日。她的初潮年龄可能是
A. 3～5岁
B. 13岁
C. 24岁
D. 29岁
E. 30岁

正确答案：B。13岁

解析：本题考查女性生殖系统生理。月经初潮年龄多在13～14岁（B对），可早至11～12岁。